女性，40岁，G3P1，现在孕18周。既往体健，10年前阴道产一男婴，现体健。最合适产前检查或技术是
A. 无创性产前检查
B. 羊膜囊穿刺术
C. 超声了解颈项厚度（NT）
D. 脐带穿刺术
E. 母体血清检查

正确答案：A。无创性产前检查

解析：该患者女性，40岁，G3P1，现在孕18周。既往体健，10年前阴道产一男婴，现体健，结合患者的表现，无创性产前检查是最合适产前检查或技术（A对）。（P66）胎儿染色体和基因疾病可通过绒毛穿刺取样、羊膜腔穿刺术、经皮脐血管穿刺取样等技术获得绒毛或胎儿细胞作出诊断（B错）。（P64-65）妊娠早期联合筛查包括超声测定胎儿颈项透明层（NT）厚度和孕妇血清学检查两类，血清学检测指标包括妊娠相关血浆蛋白（PAPP-A）和游离β-人绒毛膜促性腺激素（β-hCG）（CE错）。